患儿，6岁。形体消瘦明显，面色无华，目胞及四肢浮肿，小便短少，舌淡嫩苔薄白。其证候是
A. 疳气
B. 疳积
C. 心疳
D. 疳肿胀
E. 肾疳

正确答案：D。疳肿胀

解析：患儿形体消瘦明显，面色无华当属疳证，其目胞及四肢浮肿，小便短少，属疳肿胀（D对）。疳气症见形体略瘦，面色少华，毛发稀疏，不思饮食，精神欠佳，性急易怒，大便干稀不调（A错）。疳积见形体明显消瘦，面色萎黄，肚腹膨胀，甚则青筋暴露，毛发稀疏结穗，性情烦躁，夜卧不宁，或见揉眉挖鼻，吮指磨牙，动作异常，食欲不振，或善食易饥，或嗜食异物（B错）。心疳症见口舌生疮，甚或满口糜烂，秽臭难闻，面赤心烦，夜卧不宁（C错）。肾疳症见骨骼畸形（E错）。